常用治月经不调，头痛，风湿痹痛，被誉为“血中之气药”的药物是
A. 川芎
B. 藁本
C. 郁金
D. 当归
E. 白芍

正确答案：A。川芎

解析：川芎性善行窜，善通达气血，为妇科活血调经要药；本品秉性升散，既能活血行气止痛，又长于祛风止痛，为治头痛要药；本品辛散温通，具有祛风通络止痛之功，治疗风湿痹痛；川芎既能活血祛瘀，又能行气通滞，为“血中之气药”（A对）。藁本（B错）用于风寒感冒，巅顶疼痛，风湿痹痛。郁金（C错）用于气滞血瘀，胸胁刺痛，胸痹心痛，月经不调，经闭痛经，热病神昏，妇女倒经，黄疸尿赤，胆胀胁痛。当归（D错）用于血虚萎黄，眩晕心悸，血虚、血瘀之月经不调，经闭痛经，虚寒腹痛，风湿痹痛，痈疽疮疡，血虚肠燥便秘。白芍（E错）用于血虚萎黄，月经不调，自汗盗汗，胁痛，腹痛，四肢拘挛疼痛，头痛眩晕。